根据《麻醉药品和精神药品管理条例》，未取得麻醉药品处方资格的执业医师擅自开具麻醉药品的
A. 由药品监督管理部门取消其定点批发资格，并依照药品管理法的有关规定处罚
B. 由药品监督管理部门责令改正，给予警告，没收违法交易的药品，并处罚款
C. 由设区的市级人民政府卫生主管部门责令限期改正，给予警告
D. 由县级以上人民政府卫生主管部门给予警告，暂停其执业活动
E. 由药品监督管理部门责令限期改正，给予警告

正确答案：D。由县级以上人民政府卫生主管部门给予警告，暂停其执业活动

解析：本题考查违反麻醉药品和精神药品管理规定的法律责任。根据《麻醉药品和精神药品管理条例》，未取得麻醉药品处方资格的执业医师擅自开具麻醉药品的（D对）。执业医师违反麻醉药品和精神药品管理规定的法律责任：根据《麻醉药品和精神药品管理条例》第七十三条第一款规定，具有麻醉药品和第一类精神药品处方资格的执业医师违反规定开具相关处方，或未按临床应用指导原则使用麻醉药品和第一类精神药品的，由其所在医疗机构取消其麻醉药品和第一类精神药品处方资格，造成严重后果的，由原发证机关吊销其执业证书。执业医师未按照临床应用指导原则的要求使用第二类精神药品或者未使用专用处方开具第二类精神药品，造成严重后果的，由原发证部门吊销其执业证书。根据《麻醉药品和精神药品管理条例》第七十三条第二款规定，未取得麻醉药品和第一类精神药品处方资格的执业医师擅自开具麻醉药品和第一类精神品处方的，由县级以上卫生健康主管部门给予警告，暂停执业活动；造成严重后果的，吊销其执业证书；构成犯罪的，依法追究刑事责任。